胃大部切除术后24小时以内的胃出血，最常见的原因是
A. 凝血障碍
B. 吻合口张力过高
C. 术中止血不确切
D. 吻合口感染
E. 吻合口粘膜脱落坏死

正确答案：C。术中止血不确切

解析：术后胃出血是胃大部切除术常见的并发症，术后24小时以内的胃出血最常见的原因是术中止血不确切（C对）。（七版外科学P434）吻合口缝线处感染引起的出血，常发生在术后10～20天（D错）；吻合口黏膜坏死脱落所致的胃出血常发生于术后4～6天（E错）。八版外科学已删除上述知识点。凝血功能障碍多在术前已得到纠正，术后24小时以内一般不发生凝血障碍（A错）。吻合口张力过高（B错）是术后发生吻合口瘘的常见原因。